下列关于气性坏疽的治疗不正确的是
A. 一经诊断，应急诊清创
B. 伤口用3%过氧化氢或1：1000高锰酸钾冲洗
C. 首选氨基糖苷类抗生素
D. 高压氧治疗
E. 营养支持治疗

正确答案：C。首选氨基糖苷类抗生素

解析：氨基糖苷类抗生素对各种需氧革兰阴性杆菌具有强大的抗菌活性，但对肠球菌和厌氧菌不敏感，而气性坏疽主要病原菌为梭状芽胞杆菌，属于厌氧菌，因此氨基糖苷类抗生素对气性坏疽无效（C错，为本题正确答案）。治疗气性坏疽的首选为青霉素。气性坏疽病情发展急剧，全身情况可在12～24小时内全面恶化，因此一经诊断，应立即开始积极治疗。急诊清创属于治疗的主要措施（A对），清除失活、缺血的组织，对深而不规则的伤口充分敞开引流，可消除梭状芽胞杆菌生长的环境基础从而控制感染。伤口用3%的H₂0₂或1：1000高锰酸钾（氧化剂）冲洗（B对），既可以对局部沾染的常规细菌有杀伤作用，也可以破坏局部的缺氧环境。高压氧治疗（D对）可增加全身组织的血供，减少局部组织缺血坏死，减少芽孢杆菌适宜的生长环境。气性坏疽为严重感染，机体处于负氮平衡状态，能量代谢显著增加，须采取营养支持疗法（E对）保证热量供应。